参与劳动的是一组或多组小肌群，其量少于全身肌肉总量的1/7，肌肉收缩频率高于15次/分钟，这种作业称为
A. 静力作业
B. 动力作业
C. 反复性作业
D. 持续性收缩
E. 间断性收缩

正确答案：C。反复性作业